男，28岁。反复上腹痛2年，加重并呕吐宿食2周，伴有口渴少尿。最可能的电解质失衡种类是
A. 低钾低氯性酸中毒
B. 高钾低氯性碱中毒
C. 低钾低氯性碱中毒
D. 低钾髙氯性酸中毒
E. 低氯低镁性酸中毒

正确答案：C。低钾低氯性碱中毒

解析：患者青壮年男性，反复上腹痛2年，呕吐宿食2周，提示为溃疡病合并幽门梗阻。大量呕吐造成Cl⁻、H⁺随胃液大量丢失，一方面肠液中的HCO₃⁻未被H⁺中和即吸收入血，使血浆中的HCO₃⁻增高；另一方面，胃液中Cl⁻丢失使肾小管中Cl⁻减少，为维持离子平衡，HCO₃⁻的重吸收增加，因此导致碱中毒。而Na⁺随胃液丢失，在代偿过程中，K⁺和Na⁺交换、H⁺和Na⁺交换增加，保留了Na⁺而排出了K⁺及H⁺，造成低钾血症和碱中毒。因此该患者最可能的电解质失衡为低钾低氯性碱中毒（C对ABD错）（“短期大量呕吐引发低钾低氯性碱中毒”为常考考点）。长期的体液丢失也可导致低镁血症，但本例出现的为碱中毒，而非酸中毒（E错）。